某医师从医院辞职到一家药品生产企业从事营销工作，后因事业不顺，想重回医院工作，但因其中止执业活动已满法定期限被卫生行政部门注销注册。该法定期限是
A. 2年
B. 3年
C. 4年
D. 1年
E. 6个月

正确答案：A。2年

解析：医师注册被卫生行政部门注销注册的情形包括：①死亡或者被宣告失踪的；②受刑事处罚的；③受吊销医师执业证书行政处罚的；④因考核不合格，暂停执业活动期满，经培训后再次考核仍不合格的；⑤中止医师执业活动满2年的（A对）；⑥身体健康状况不适宜继续执业的；⑦有出借、出租、抵押、转让、涂改《医师执业证书》行为的；⑧有国务院卫生行政部门规定不宜从事医疗、预防、保健业务的其他情形的。